某女，56岁，小便点滴而下，量极少而短赤灼热，小腹胀满，口苦口黏，渴不欲饮，大便不畅。舌质红，苔黄腻，脉滑数。中医辨证是
A. 肾阳衰惫
B. 膀胱湿热
C. 肾阴亏虚
D. 脾胃气虚
E. 肝气郁结

正确答案：B。膀胱湿热

解析：本题考查的是癃闭的辨证论治。小便点滴而下，量极少而短赤灼热，小腹胀满，口苦口黏，渴不欲饮，大便不畅。舌质红，苔黄腻，脉滑数。中医辨证是膀胱湿热（B对）。癃闭是以小便量少，排尿困难，甚则小便闭塞不通为主症的疾病。西医学中各种原因引起的尿潴留及无尿症，如神经性尿闭、膀胱括约肌痉挛、尿道结石、尿路肿瘤、尿道损伤、尿道狭窄、前列腺增生症、脊髓炎等病所出现的尿潴留以及肾功能不全引起的少尿、无尿症，可参考此内容辨证论治，但同时还应注意结合辨病求因治疗。（一）膀胱湿热证：【症状】小便点滴不通，或量极少而短赤灼热，小腹胀满，口苦口黏，或口渴不欲饮，或大便不畅。舌质红，苔黄腻，脉数。（二）湿热瘀阻证：【症状】小便点滴而下，或尿如细线，甚则阻塞不通，烦躁口苦。舌质紫暗或有瘀点。舌苔黄腻，脉涩。（三）肾阳衰惫（A错）证：【症状】小便不通或点滴不爽，排出无力，面色㿠白，神气怯弱，畏寒肢冷，腰膝冷而酸软无力。舌淡胖，苔薄白，脉沉细或弱。肾阴亏虚（C错）为消渴的辨证。消渴肾阴亏虚证：【症状】尿频量多，浊如膏脂，腰酸膝软，头晕耳鸣，多梦遗精，乏力，皮肤干燥。舌红少苔，脉细数。脾胃气虚（D错）为消渴的辨证。消渴脾胃气虚证：【症状】口渴引饮，能食与便溏并见，或饮食减少，精神不振，四肢乏力。舌淡，苔薄白而干，脉细弱无力。肝气郁结（E错）为郁证的辨证。郁证肝气郁结证：【症状】精神抑郁，情绪不宁，胸部满闷，胁肋胀痛，痛无定处，胸闷嗳气，喜太息，不思饮食，大便不调，或秘或溏泄。舌苔薄或腻，脉弦。